治疗种植体周围组织病变的基本原则不正确的是
A. 诱导骨再生
B. 制止骨丧失
C. 控制感染
D. 消除种植体周袋
E. 手用传统金属洁治器彻底清洁

正确答案：E。手用传统金属洁治器彻底清洁

解析：机械清除天然牙及种植义齿各个部分如种植颈、种植基台、上部结构龈面等处的菌斑、牙石。必须用塑料器械或与种植体同样硬度的钛刮治器，使牙石碎裂，用橡皮杯和抛光膏抛光种植体表面以清除菌斑。由于钛种植体表面易磨损，传统的金属刮治器不能用于种植体，它们会损伤钛表面，形成粗糙面，促使菌斑沉积。掌握“种植体周围组织疾病”知识点。